属于细胞因子的物质是
A. 植物血凝素
B. 干扰素
C. 调理素
D. 乙型溶素
E. 胸腺素

正确答案：B。干扰素

解析：干扰素（interferon，IFN）因能干扰病毒在宿主细胞内复制而得名，是能使细胞获得抗病毒能力的细胞因子。掌握“细胞因子及受体”知识点。